下列各项，不属于主治风湿热痹药物的是
A. 白鲜皮、薏苡仁
B. 独活、威灵仙
C. 连翘、络石藤
D. 黄柏、木瓜
E. 木通、防己

正确答案：B。独活、威灵仙

解析：独活为治风湿痹痛主药，凡风寒湿邪所致之痹证，无论新久，均可应用。威灵仙治疗凡风湿痹痛，肢体麻木，筋脉拘挛，屈伸不利，无论上下皆可应用，尤宜于风邪偏盛，拘挛掣痛，游走不定者（B对）。白鲜皮功效为清热燥湿，治疗风湿热痹。薏苡仁的功效为利水渗湿，除痹。治疗湿痹拘挛（A错）。连翘的功效为清热解毒，消肿散结，疏散风热。治疗痈疽，瘰疬，乳痈，丹毒；风热感冒，温病初起，热入营血、高热烦渴、神昏发斑；热淋涩痛。络石藤的功效为祛风通络，凉血消肿。治疗风湿热痹，筋脉拘挛，腰膝酸痛（C错）。黄柏的功效为清热燥湿，泻火解毒，除骨蒸。治疗湿热泻痢，黄疸尿赤，带下阴痒，热淋涩痛，脚气痿躄；骨蒸劳热，盗汗，遗精；疮疡肿毒，湿疹湿疮。木瓜的功效为舒筋活络，和胃化湿。治疗湿痹拘挛，腰膝关节酸重疼痛（D错）。木通的功效为利尿通淋，清心除烦，通经下乳。治疗淋证，水肿；心烦尿赤，口舌生疮；经闭乳少，湿热痹痛。防己辛能行散，苦寒降泄，既能祛风除湿止痛，又能清热。对风湿痹证湿热偏盛，肢体酸重，关节红肿疼痛，及湿热身痛者，尤为要药（E错）。